成釉细胞瘤最容易发现是哪一型
A. 滤泡型
B. 单囊型
C. 骨外/外周型
D. 促结缔组织增生型
E. 棘皮瘤型

正确答案：A。滤泡型

解析：本题考查成釉细胞瘤的亚型。成釉细胞瘤最容易发现滤泡型。成釉细胞瘤的组织结构和细胞形态变异较多，可表现为滤泡型、丛状型、棘皮瘤型（E错）、颗粒细胞型、基底细胞型、角化成釉细胞瘤。这些组织学亚型中以滤泡型（A对）和丛状型最为常见，其中有些亚型往往混合出现。成釉细胞瘤还可表现为单囊型（B错）﹑骨外/外周型（C错）和转移性成釉细胞瘤三种特殊亚型（D错）。